患者经抗肿瘤治疗后尿检发现大量葡萄糖和氨基酸，推测其肾单位受损部位是
A. 近端小管
B. 肾小球
C. 集合管
D. 髓袢升支粗段
E. 远端小管

正确答案：A。近端小管

解析：癌症患者经抗肿瘤治疗可能会造成肾损伤，题中患者尿检发现了大量葡萄糖和氨基酸，而葡萄糖和氨基酸都是在近端小管被重吸收的，故推测该患者的肾单位受损部位是近端小管（A对）。经肾小球滤过后，肾小囊超滤液中的葡萄糖及氨基酸浓度与血浆相等，患者经抗肿瘤治疗后尿检发现大量葡萄糖和氨基酸，和肾小球（B错）没有关系。髓袢升支粗段（D错）主要涉及NaCl的重吸收。远曲小管（C错）和集合管（E错）重吸收的物质主要涉及NaCl和水，在内髓部集合管还存在尿素重吸收。